麻疹合并肺炎喘嗽的患儿在出疹后，需隔离多少天
A. 3
B. 5
C. 8
D. 10
E. 14

正确答案：D。10

解析：麻疹的预防：易感儿进行麻疹减毒活疫苗预防接种，在麻疹流行期间，对麻疹患者做到早诊断、早报告、早治疗。患儿隔离至出疹后5天（B错），并发肺炎者，延长隔离至出疹后10天（D对）。